肺结核患者的管理重点内容是
A. 督导患者复查
B. 督导患者休息
C. 督导化疗
D. 指导患者消毒
E. 隔离患者治疗

正确答案：C。督导化疗

解析：本题考查肺结核患者的管理重点内容。肺结核患者的管理重点内容是督导化疗（C对ABDE错）。治疗有效的抗结核药物和规范的督导化疗能使90%的病人获得治愈。积极发现和治愈传染性病人是目前阻断结核病传播、防制耐药结核病发生的最有效的方法。